《中华人民共和国献血法》成立于
A. 第六届全国人大常委会第29次会议
B. 第七届全国人大常委会第29次会议
C. 第八届全国人大常委会第29次会议
D. 第七届全国人大常委会第28次会议
E. 第八届全国人大常委会第28次会议

正确答案：C。第八届全国人大常委会第29次会议

解析：本题考查无偿献血、医疗机构和血站职责及法律责任。为保证医疗临床用血的需要和安全，保障献血者和用血者的身体健康，发扬人道主义精神，促进社会主义物质文明和精神文明建设，1997年12月29日，第八届全国人大常委会第29次会议（C对）通过了《中华人民共和国献血法》（以下简称《献血法》），自1998年10月1日起施行。